职业病诊断证明书的有效条件是
A. 由医师签署并盖章
B. 由参与诊断的医师签署并盖章
C. 由参与诊断的医师共同签署，并经医疗卫生机构盖章
D. 由参与诊断的医师签署，并经承担职业病诊断的医疗卫生机构审核盖章
E. 由参与诊断的医师共同签器，并经承担职业病诊断的医疗卫生机构审核盖章

正确答案：E。由参与诊断的医师共同签器，并经承担职业病诊断的医疗卫生机构审核盖章